X线对牙周疾病的诊断作用，最准确的描述
A. 是牙周疾病诊断的决定性手段
B. 是非常重要的诊断工具，但不能取代临床检查
C. 能独立给牙周疾病作出正确诊断
D. 牙周病的诊断需要拍咬牙合翼片
E. 以上均对

正确答案：B。是非常重要的诊断工具，但不能取代临床检查

解析：本题考查牙周病的影像学检查。X线对牙周疾病的诊断作用，最准确的描述是是非常重要的诊断工具，但不能取代临床检查（B对）。X线影像对于牙周疾病是一项重要而常用的检查方法，但它只是对牙周炎的辅助诊断（A错），应结合牙周专科临床检查，综合分析判断，单凭X线无法做出正确诊断（C错）。牙周病的诊断一般拍摄全口曲面体层片，若想观察牙周组织的细微变化可以拍摄根尖片，咬合翼片主要用于观察邻面龋、髓石、髓腔等，不能完整显示整个牙根（D错）。